下列哪项不是备洞时意外穿髓的原因
A. 操作不仔细
B. 髓腔变异
C. 未掌握正确的开髓方法
D. 去龋时使用锋利裂钻
E. 深龋去腐时使用慢速球钻

正确答案：E。深龋去腐时使用慢速球钻

解析：本题考查备洞时意外穿髓的原因。深龋去腐时应用挖器挖除或低速球钻磨除，切忌用高速涡轮机去除，以减小意外穿髓的风险（E错，为本题的正确答案）。备洞过程中意外穿髓的原因有：操作不仔细（A对）、髓腔变异（B对）、未掌握正确的开髓方法（C对）、去腐时使用锋利裂钻（D对）等。